某女，78岁。因多种疾病长期服用保和丸、稳心颗粒、鼻炎康片、百令胶囊、六味地黄丸，近日出现恶心、纳差、厌油腻、乏力、尿黄，到药学门诊咨询药师。药师仔细询问病情和用药史后，考虑为药源性肝损伤，可疑药物是
A. 保和丸
B. 百令胶囊
C. 稳心颗粒
D. 鼻炎康片
E. 六味地黄丸

正确答案：D。鼻炎康片

解析：本题考查可致肝损伤的常用中成药。药师仔细询问病情和用药史后，考虑为药源性肝损伤，可疑药物是鼻炎康片（D对）。可致肝损伤的常用中成药：近年报道发生肝损伤的中成药有：复方青黛丸、壮骨关节丸、克银丸、雷公藤制剂、追风透骨丸、天麻丸、昆明山海棠片、腰痛宁胶囊、尪痹冲剂（片）、通络开痹片、复方雪莲胶囊、鼻炎康片等。合理用药指导：脾胃虚弱者慎用保和丸（A错）、小儿消食片、小儿化食丸、大山楂丸、四磨汤口服液。外感实证咳喘者慎用百令胶囊（B错）。孕妇慎用稳心颗粒（C错）。感冒患者慎用麦味地黄丸、六味地黄丸（E错）；阳虚、脾虚、气滞患者慎用六味地黄丸。不建议将麦味地黄丸与六味地黄丸同时使用，因属重复用药。